肺癌所致阻塞性肺炎有以下临床征象，除了
A. 患者一般不发热或仅有低热
B. 血白细胞计数常不增高
C. 抗生素治疗后炎症很快吸收消散
D. 经抗生素治疗炎症吸收后出现肿块阴影
E. 短期内同-部位可反复出现炎症

正确答案：C。抗生素治疗后炎症很快吸收消散

解析：肺癌所致阻塞性肺炎抗生素治疗后，炎症吸收缓慢且多不能完全吸收（C错，为本题正确答案），治疗后可出现肿块阴影（D对）。肺癌所致阻塞导致短期内同-部位可反复出现炎症（E对）。肺癌所致阻塞性肺炎患者因晚期恶病质一般不发热或仅有低热（A对），血白细胞计数也常不增高（B对）。